关于药物依赖定义的描述，以下正确的是
A. 指使用医学上不必要的药物
B. 指对药物强烈的渴求
C. 指渴求服药以获药后快感
D. 指需服药物，以后发生戒断综合征
E. 指对药物的有害使用

正确答案：B。指对药物强烈的渴求